18岁男性，右颌下区无痛性质软肿物发现三月，表面皮肤正常，口内检查亦未见异常。行颌下手术时见肿物呈囊性，术中囊壁破裂，流出粘稠而略带黄色蛋清样液体，遂将囊壁及颌下腺一并摘除，但术后不久囊肿复发。该病的最适治疗方法是
A. 切除颌下腺，吸尽囊液，加压包扎
B. 完整摘除囊壁，加压包扎
C. 切除颌下腺及摘除囊壁
D. 切除舌下腺及摘除囊壁
E. 切除舌下腺，吸尽囊液，加压包扎

正确答案：E。切除舌下腺，吸尽囊液，加压包扎

解析：本题考查舌下腺囊肿的治疗。根治舌下腺囊肿的方法是切除舌下腺，残留部分囊壁不致造成复发。对于口外型舌下腺囊肿，可全部切除舌下腺后，将囊腔内的囊液吸净，在下颌下区加压包扎（E对），而不必在下颌下区作切口摘除囊肿。对全身情况不能耐受舌下腺切除的患者及婴儿，可作简单的成形性囊肿切开术，即袋形缝合术，切覆盖囊肿的部分黏膜和囊壁，放尽液体，填入碘仿纱条。待全身情况好转或婴儿长至4～5岁后再行舌下腺切除。